下列选项属于碳酸锂的不良反应的是
A. 引起瞳孔增大
B. 引起呼吸抑制
C. 惊厥
D. 引起急性呼吸衰竭
E. 引起周围神经炎

正确答案：C。惊厥

解析：碳酸锂的不良反应较多，安全范围窄，最适浓度为0.8～1.5mmol/L之间，超过2mmol/L即出现中毒症状。轻度的中毒症状包括恶心、呕吐、腹痛、腹泻和细微震颤；较严重的毒性反应涉及神经系统，包括精神紊乱、反射亢进、明显震颤、发音困难、惊厥（C对），直至昏迷与死亡。引起瞳孔增大（A错）为阿托品的常见不良反应。引起呼吸抑制（B错）为吗啡的常见不良反应。引起急性呼吸衰竭（D错）常是一氧化氮中毒和安眠药中毒引起的。引起周围神经炎（E错）常为抗结核药物异烟肼的不良反应。